鱼肝油乳剂中，西黄蓍胶用作
A. 增溶剂
B. 润湿剂
C. 稳定剂
D. 乳化剂
E. 抑菌剂

正确答案：C。稳定剂

解析：本题考查鱼肝油乳剂的处方分析。鱼肝油乳剂中，西黄蓍胶用作稳定剂（C对）。鱼肝油乳剂【注解】处方中鱼肝油为药物，兼作油相；阿拉伯胶为乳化剂（D错）；西黄蓍胶为稳定剂；糖精钠和杏仁油为矫味剂；羟苯乙酯为防腐剂。增溶是指难溶性药物在表面活性剂形成的胶团作用下，在溶剂中溶解度增加并形成溶液的过程。具有增溶作用的表面活性剂称为增溶剂。增溶剂（A错）的最适宜亲水亲油平衡值（HLB）为15～18，常用的增溶剂为聚山梨酯、聚氧乙烯脂肪酸酯类等。炉甘石洗剂【注解】炉甘石、氧化锌为药物，甘油为润湿剂（B错），羧甲基纤维素钠为助悬剂。制备时将炉甘石和氧化锌粉末先加甘油研成细糊，与羧甲基纤维素钠水溶液混合，使粉末周围形成水的保护膜，阻碍颗粒的聚集，振摇时易摇匀。抑菌剂（E错）多剂量眼用制剂，应加适当抑菌剂。常用的抑菌剂有三氯叔丁醇、硝酸苯汞、苯乙醇、羟苯乙酯等。